女，60岁，身高170cm，体重65kg。每天所需基本热量约为
A. 2900kcal
B. 2200kcal
C. 1200kcal
D. 1600kcal
E. 1000kcal

正确答案：D。1600kcal

解析：此题为老题目，但按照九版外科书（P100）数据进行计算，正常机体热量每天基本需要量25-30kcal/kg，可知此病人每天的热量需要量为1625-1950kcal（D对）。